患者因颈椎，腰椎疼痛服用某药，出现眼黄，尿黄，乏力，纳差和肝功能异常，停用该药后症状缓解和好转。患者个人可以向
A. 药品经营企业报告
B. 药品生产企业报告
C. 药品不良反应监测机构报告
D. 经治医师报告

正确答案：A、B、C、D。药品经营企业报告；药品生产企业报告；药品不良反应监测机构报告；经治医师报告

解析：本题考查个例药品不良反应的报告。患者因颈椎，腰椎疼痛服用某药，出现眼黄，尿黄，乏力，纳差和肝功能异常，停用该药后症状缓解和好转。患者个人可以向药品经营企业报告（A对）、药品生产企业报告（B对）、药品不良反应监测机构报告（C对）与经治医师报告（D对）。《药品不良反应报告和监测管理办法》第三章报告与处置第二节个例药品不良反应第二十三条：个人发现新的或者严重的药品不良反应，可以向经治医师报告，也可以向药品生产、经营企业或者当地的药品不良反应监测机构报告，必要时提供相关的病历资料。